30岁男性，30分钟前被刀刺右前胸部，咳血痰，呼吸困难。体检：血压107/78mmHg，脉搏96次/分，右前胸有轻度皮下气肿，右锁骨中线4肋间可见3cm长创口，随呼吸有气体进出伤口响声。此时应采取的急救措施是
A. 吸氧
B. 静脉穿刺输液
C. 摄胸部X线片
D. 立即闭合胸部创口
E. 立即剖胸探查

正确答案：D。立即闭合胸部创口

解析：青年男性患者，右前胸部刀刺伤，可见创口，有气体进出响声，且右前胸有皮下气肿，结合患者病史和临床表现，考虑该患者为开放性气胸。开放性气胸患者可出现纵隔扑动和移位，影响静脉回心血流，引起循环障碍，急救时应立即闭合胸部创口，将开放性气胸转变为闭合性气胸（D对），然后再按照闭合性气胸进行处理。吸氧（A错）、静脉穿刺输液（B错）、拍摄胸部X线片（C错）均为入院后的进一步处理，不属于急救措施。剖胸探查（P247）（E错）用于进行性血胸、心脏大血管损伤等严重的胸部损伤。